正常人体血液总量占体重的
A. 45%
B. 16%
C. 10%
D. 8%
E. 6%

正确答案：D。8%

解析：正常人体血液总量占体重的8%（D对）。